细胞水肿时，主要发生病变的细胞器是
A. 线粒体和内质网
B. 高尔基复合体和线粒体
C. 核糖体和内质网
D. 内质网和中心体
E. 核糖体和中心体

正确答案：A。线粒体和内质网

解析：细胞水肿时，由于线粒体受损，ATP生成减少，细胞膜Na⁺-K⁺泵功能障碍，导致细胞内Na⁺积聚吸引大量水分进入，致使线粒体和内质网（A对）明显肿胀。高尔基复合体、中心体和核糖体虽然也可以发生肿胀，但不是最主要的病变细胞器。